新生儿脑损伤高危因素的Apgar评分是
A. 1分钟≤3分
B. 1分钟≤5分
C. 5分钟≤3分
D. 5分钟≤7分
E. 5分钟≤9分

正确答案：C。5分钟≤3分